男，55岁，反复活动时胸痛，快步行走及上楼梯可诱发，休息可缓解。冠状动脉造影见前降支阻塞80%。血管病变的始动环节是
A. 巨噬细胞形成泡沫细胞
B. 纤维帽破裂、血栓形成
C. 平滑肌细胞增殖和迁移
D. 内皮细胞受损及功能失调
E. 内皮下脂质沉积

正确答案：D。内皮细胞受损及功能失调

解析：患者中老年男性（冠心病好发人群），活动时胸痛，快步行走及上楼梯可诱发，休息可缓解（胸痛，体力劳动诱发，休息缓解是稳定型心绞痛常见表现）。冠状动脉造影见前降支阻塞80%（冠心病影像学诊断金标准）。综合患者临床表现及辅助检查结果可初步诊断为：冠心病（稳定型心绞痛），该病由冠状动脉粥样硬化引起，关于动脉粥样硬化的形成机制，近年来多数学者支持“内皮损伤反应学说”。该学说认为，动脉粥样硬化始于内皮细胞受损及功能失调（D对）；内皮细胞屏障功能的损伤，引起内皮下脂质沉积（E错）等改变，进一步加重内皮细胞的损伤；在此基础上，单核细胞从内皮下移入内膜下成为巨噬细胞，吞噬已进入内膜发生氧化的脂质，形成泡沫细胞（A错）；内皮细胞损伤后的更新、增生、并分泌生长因子，又促使动脉中膜平滑肌细胞增殖和迁移（C错）。纤维帽破裂、血栓形成（B错）是动脉粥样硬化的继发病变，不是血管病变的形成环节。